阻滞麻醉病人的感觉是
A. 痛觉、压觉、冷觉、温觉存在
B. 痛觉、压觉、冷觉、温觉消失
C. 压觉、冷觉、温觉消失
D. 痛觉存在，触觉消失
E. 温度觉、触觉存在，痛觉消失

正确答案：E。温度觉、触觉存在，痛觉消失

解析：本题考查阻滞麻醉。阻滞麻醉病人的感觉是温度觉、触觉存在，痛觉消失（E对）。阻滞麻醉是将局麻药液注射到神经干或其主要分支附近，以阻断神经末梢传入的刺激，使被阻滞神经分布的区域产生麻醉的方法。病人的感觉是温度觉、触觉存在，痛觉消失。